阻塞性肺气肿病人肺通气指标肯定下降的是
A. 一秒用力呼气量
B. 肺活量
C. 潮气量
D. 功能残气量
E. 肺总量

正确答案：A。一秒用力呼气量

解析：阻塞性肺气肿病人，呼气困难更明显，一秒用力呼气量（FEV1）（A对）明显下降，因FEV1的降低比FVC更明显，FEV1/FVC变小；限制性呼气困难的病人，吸气困难更明显，肺总量（E错）明显下降。肺活量（B错）、潮气量（C错）和功能残气量（D错）在阻塞性肺气肿病人早期由于代偿作用可保持不变，在晚期，肺活量和潮气量减小，功能残气量增加。